部分参与颈动脉窦的形成的是
A. 椎动脉
B. 颈内动脉
C. 面动脉
D. 胸廓内动脉
E. 肺动脉

正确答案：B。颈内动脉

解析：颈内动脉（B对）和颈总动脉共同参与颈动脉窦的形成。